反式作用因子的确切定义是指
A. 调控任意基因转录的某一基因编码蛋白质
B. 调控另一基因转录的某一基因编码蛋白质
C. 具有转录调节功能的各种蛋白质因子
D. 具有翻译调节功能的各种蛋白质因子
E. 具有基因表达调控功能的各种核因子

正确答案：B。调控另一基因转录的某一基因编码蛋白质